急性肾功能衰竭少尿期结束的标志是指24小时尿量至少增加至
A. 250ml
B. 300ml
C. 350ml
D. 400ml
E. 500ml

正确答案：D。400ml

解析：正常成人24小时尿量约为1000～2000ml；24h尿量少于400ml，或每小时尿量少于17ml称为少尿；如24小时尿量少于100ml，12小时完全无尿称为无尿；如24小时尿量超过2500ml称为多尿。急性肾功能衰竭少尿期，肾小球滤过功能受损，尿量产生减少，患者可出现少尿或者无尿。当肾功能逐渐恢复，肾小球滤过率增加，当24小时尿量增加至400ml（D对）时，少尿期结束进入恢复期，此阶段每日尿量可达3000～5000ml，或者更多。